下列不是用来评价油脂酸败的指标是
A. 酸价
B. 过氧化值
C. 羰基价
D. 丙二醛
E. 苯并(a)芘

正确答案：E。苯并(a)芘